Wernicke脑病缺乏
A. 维生素B1
B. 维生素B
C. 维生素B6
D. 维生素A
E. 维生素C

正确答案：A。维生素B1

解析：维生素B1缺乏会引起Wernicke脑病（A对）。